Ⅰ度松动的牙松动方向是
A. 仅有唇（颊）舌向松动
B. 唇（颊）舌向及近远中向均有松动
C. 近远中向及垂直向均有松动
D. 唇（颊）舌向及近远中向松动，并伴有垂直向松动
E. 以上均不对

正确答案：A。仅有唇（颊）舌向松动

解析：临床上常用的牙松动度测量和记录的方法有两种：①以牙松动幅度计算：Ⅰ度松动：松动幅度不超过1mm。Ⅱ度松动：松动幅度为1～2mm。Ⅲ度松动：松动幅度大于2mm；②以牙松动方向计算：Ⅰ度松动：仅有唇（颊）舌向松动。Ⅱ度松动：唇（颊）舌向及近远中向均有松动。Ⅲ度松动：唇（颊）舌向及近远中向松动，并伴有垂直向松动。掌握“修复学临床检查”知识点。